慢性毒作用带为
A. 半数致死剂量/急性阈剂量的比值
B. 急性阈剂量/半数致死剂量的比值
C. 急性阈剂量/慢性阈剂量的比值
D. 慢性阈剂量/急性阈剂量的比值

正确答案：C。急性阈剂量/慢性阈剂量的比值

解析：本题考查慢性毒作用带。慢性毒作用带为急性阈剂量/慢性阈剂量的比值（C对ABD错）。慢性毒作用带值大，发生慢性中毒的危险性大；反之，则发生慢性中毒的危险性小。